膀胱刺激征是指
A. 尿急，尿痛，血尿
B. 尿频，尿痛，排尿困难
C. 尿频，尿急，尿痛
D. 尿急，血尿，排尿困难
E. 血尿，尿痛，尿失禁

正确答案：C。尿频，尿急，尿痛

解析：膀胱刺激征是指尿频、尿急、尿痛（C对），也称尿道刺激症，常见于急性膀胱炎、肾结核等。排尿困难（BD错）常见于泌尿系梗阻，血尿（ADE错）常提示有泌尿系肿瘤的可能。